热淋涩痛，可用
A. 贯众
B. 连翘
C. 大青叶
D. 板蓝根
E. 金银花

正确答案：B。连翘

解析：连翘为清热解毒药，苦、微寒，归肺、心、小肠经。可清热解毒、消肿散结、疏散风热。可用于治疗痈疽、瘰疬、乳痈、丹毒；风热感冒，温病初起，温热入营，高热烦渴，神昏发斑；热淋涩痛（B对）。贯众可用于治疗时疫感冒、风热头痛、温毒发斑；痄腮、疮疡肿毒；血热崩漏；虫积腹痛（A错）。大青叶可用于治疗温病高热、神昏、发斑发疹；痄腮，喉痹，口疮，丹毒，痈肿（C错）。板蓝根可用于治疗瘟疫时毒、发热咽痛；温毒发斑、痄腮、烂喉丹痧、大头瘟疫、丹毒、痈肿（D错）。金银花可用于治疗痈肿疔疮、喉痹、丹毒；风热感冒、温病发热；热毒血痢（E错）。